肠系膜下动脉的分布范围包括
A. 十二指肠和胰
B. 空、回肠
C. 阑尾、盲肠、升结肠
D. 升结肠、横结肠、乙状结肠
E. 降结肠、乙状结肠、直肠上段

正确答案：E。降结肠、乙状结肠、直肠上段

解析：肠系膜下动脉在约平第3腰椎的高度发自腹主动脉的前壁，其分布范围包括降结肠、乙状结肠和直肠上部（E对）。